Ⅱ度骨吸收描述的骨破坏情况是
A. 牙槽骨吸收在根颈1/3以内
B. 牙槽骨吸收超过根长的1/3，但在根长2/3以内或达根长1/2
C. 牙槽骨吸收占根长的2/3以上
D. 牙槽骨吸收占根长的1/2以上，3/4以内
E. 牙槽骨吸收在根颈1/2以内

正确答案：B。牙槽骨吸收超过根长的1/3，但在根长2/3以内或达根长1/2

解析：本题考查骨吸收程度的分类。Ⅱ度骨吸收描述的骨破坏情况是牙槽骨吸收超过根长的1/3，但在根长2/3以内或达根长1/2（B对）。骨吸收情况反映牙周组织的破坏程度。骨吸收的程度一般按吸收区占牙根长度的比例来描述，通常分为三度。Ⅰ度：牙槽骨吸收在牙根的颈1/3以内（A错）。Ⅱ度：牙槽骨吸收超过根长1/3，但在根长2/3以内，或吸收达根长的1/2。Ⅲ度：牙槽骨吸收大于根长2/3（C错）。牙槽骨吸收占根长的1/2以上，3/4以内（D错），牙槽骨吸收在根颈1/2以内（E错），没有这两种划分方法。